某地甲肝发病率通常在2%，为降低该地甲肝对人群健康的危害，拟普种甲肝疫苗。该疫苗的效果指数为10，则通过疫苗的接种，可望使该地甲肝发病率下降至
A. 0.002
B. 0.018
C. 0.019
D. 0.02
E. 以上都不对

正确答案：A。0.002